患者，女，35岁。寒战发热、腰痛伴尿频、尿痛2天。尿常规检查：红细胞（﹢﹢﹢），白细胞（﹢﹢﹢），尿蛋白（﹢）血常规检查：白细胞计数增高。应首先考虑的诊断是
A. 急性肾盂肾炎
B. 急性膀胱炎
C. 急性肾炎
D. 肾结核
E. 肾脓肿

正确答案：A。急性肾盂肾炎

解析：急性肾盂肾炎（A对）可见于任何年龄，育龄期妇女最多见，起病急骤，临床表现为发热、寒战、头痛、全身酸痛等，体温多在38度以上，多为弛张热，也可呈稽留热或间歇热。泌尿系症状有尿频、尿急、尿痛、排尿困难、下腹部疼痛、腰痛等，少数还有剧烈的腹部阵发性绞痛，沿输尿管向膀胱方向放射。腰痛程度不一，多为钝痛或酸痛。体检时在肋腰点（腰大肌外缘与第12肋交叉点）有压痛，肾区叩击痛。常规检查可见尿中有白细胞、血细胞、蛋白，诊断明确故（BCDE错）。